患者，男，30岁。高热、寒战2天，胸痛，伴咳嗽，痰中带血。听诊：右肺中部可闻及湿性啰音。应首先考虑的是
A. 急性支气管炎
B. 肺炎
C. 肺结核
D. 肺癌
E. 支气管哮喘

正确答案：B。肺炎

解析：患者青年男性，高热、寒战2天，胸痛，伴咳嗽，痰中带血，右肺中部可闻及湿性啰音，患者临床表现与肺炎相符，故该患者最可能的诊断是肺炎（B对）。急性支气管炎（P17）（A错）通常起病较急，全身症状较轻，可有发热。肺结核（P61）（C错）主要表现为乏力、低热、盗汗等结核分枝杆菌感染中毒症状。肺癌（P78）（D错）主要表现为咳嗽、痰血或咯血、气短或喘鸣、发热、体重下降等。支气管哮喘（P30）（E错）主要表现为发作性带有哮鸣音的呼气性呼吸困难。